上1暂时冠修复，后期牙冠比色
A. 饱和度小于侧切牙
B. 饱和度小于尖牙
C. 饱和度大于尖牙
D. 明度小于侧切牙
E. 明度小于尖牙

正确答案：B。饱和度小于尖牙

解析：本题考查天然牙的颜色特征。上1暂时冠修复，后期牙冠比色饱和度小于尖牙（B对）。上颌前牙中，中切牙亮度最大，尖牙亮度最小，但尖牙的饱和度最高。这一特点在年轻女性中非常明显。